幻觉是指
A. 脑的一种丰富想象的思维过程
B. 脑的对客观事物的一种错误猜想
C. 感觉器官在梦幻中的一种知觉体验
D. 感觉器官对客观事物的错误知觉体验
E. 感觉器官缺乏客观刺激时的知觉体验

正确答案：E。感觉器官缺乏客观刺激时的知觉体验

解析：幻觉是没有现实刺激作用于感觉器官时出现的知觉体验（E对），是一种虚幻的知觉。